n足够大，P不接近于0或1，样本率与总体率比较，统计量μ为
A. |P-π|/Sp
B. |P1-P2|/σp
C. |P1-P2|/Sp
D. |P-π|/σ
E. |P-π|/σp

正确答案：E。|P-π|/σp

解析：μ检验常用于样本率与总体率比较，其适用条件是：样本含量n足够大，样本率P和（1-P）均不接近0。此时P的分布近似正态分布，统计量μ值的计算公式为：μ=|P-π|/σp（E对）。